某男，54岁。1年前，爪甲菲薄发软，影响工作。虽多方求治但收效不大。刻下面黄，夜寐多梦，时有头晕心慌，纳食与二便正常；舌淡红苔薄白脉细沉。血红蛋白偏低。医师诊为肝血不足、筋爪失养治养血补肝益筋。药用熟地黄12g、山茱萸10g、当归10g、炒白芍10g、五味子5g打碎、阿胶珠10g、炒酸枣仁15g打碎、川芎5g、木瓜10g、生牡蛎30g打碎先煎、夜交藤15g。10剂每日1剂水煎分2次服。以此方加减治疗数月爪甲复常。方中性微温，既滋阴又补血的药是
A. 山茱萸
B. 炒白芍
C. 熟地黄
D. 阿胶珠
E. 木瓜

正确答案：C。熟地黄

解析：本题考查的是熟地黄的性味归经与功效。方中性微温，既滋阴又补血的药是熟地黄（C对）。熟地黄：【性味归经】甘，微温。归肝、肾经。【功效】补血滋阴，补精益髓。山茱萸（A错）：【性味归经】酸、甘，微温。归肝、肾经。【功效】补益肝肾，收敛固脱。白芍（B错）：【性味归经】酸、甘、苦，微寒。归肝、脾经。【功效】养血调经，敛阴止汗，柔肝止痛，平抑肝阳。阿胶（D错）：【性味归经】甘，平。归肺、肝、肾经。【功效】补血止血，滋阴润燥。木瓜（E错）：【性味归经】酸，温。归肝、脾经。【功效】舒筋活络，化湿和中，生津开胃。